流行病学中的偏倚分为
A. 住院偏倚，测量偏倚，转诊偏倚
B. 住院偏倚，测量偏倚，信息偏倚
C. 选择偏倚，信息偏倚，混杂偏倚
D. 测量偏倚，混杂偏倚，回忆偏倚
E. 混杂偏倚，住院偏倚，回忆偏倚

正确答案：C。选择偏倚，信息偏倚，混杂偏倚